在休克的发生发展中引起血小板解聚和血管舒张作用最强的是：
A. PGE2
B. PGH2
C. PGI2
D. PAF
E. TXA2

正确答案：C。PGI2

解析：PGI2（前列环素）（C对）具有抑制血小板聚集和扩张小血管和引起血管舒张的作用。PGE2（前列腺素E2）（A错）具有引起血管舒张的作用。PAF（血小板活化因子）（D错）可导致后微动脉、毛细血管前括约肌舒张和血管通透性增加。TXA 2 （E错）则具有促进血小板聚集和收缩小血管的作用。